宫颈活检的病理报告为“鳞状上皮化生”，临床上应认为是
A. 无病变
B. 良性病变
C. 癌前病变
D. 低度恶性病变
E. 高度恶性病变

正确答案：B。良性病变

解析：宫颈鳞状上皮化生是一种良性病变（B对），生成的细胞大小形态一致，无核深染、异型或异常分裂象。其既不同于子宫颈阴道部的正常鳞状上皮（A错）又不同于癌前病变（C错），即不典型增生。未成熟的化生鳞状上皮在人乳头瘤病毒等的刺激下，发生细胞异常增生，最后形成CIN（子宫颈上皮内瘤变）。宫颈低度（D错）和高度恶性病变（E错）是子宫颈癌的病理变化，表现为异型细胞突破基底膜，浸润间质。